中药方剂有因剂型改变而方名改变者，如传统方理中丸与人参汤两方均由干姜、白术、人参、甘草组成用量完全相同。前者制法是共为细末炼蜜为丸如鸡子黄大；后者为汤剂。通常临床所见疾病往往复杂多变，可谓病有缓急证有表里，同一中药处方可因剂型不同，作用有所差异。应根据病情的不同，选择不同的剂型给药。理中丸为大蜜丸，《中国药典》对大蜜丸溶散时限的规定是
A. 不检查溶散时限
B. 应在30分钟内溶散
C. 应在1小时内溶散
D. 应在2小时内溶散
E. 应按肠溶衣片崩解时限检查法检查

正确答案：A。不检查溶散时限

解析：本题考查的是丸剂的溶散时限。理中丸为大蜜丸，《中国药典》对大蜜丸溶散时限的规定是不检查溶散时限（A对）。丸剂的溶散时限：除另有规定外，小蜜丸、水蜜丸和水丸应在1小时内全部溶散（C错）；浓缩丸和糊丸应在2小时内全部溶散（D错）；滴丸应在30分钟内全部溶散（B错），包衣滴丸应在1小时内全部溶散。蜡丸照崩解时限检查法片剂项下的肠溶衣片检查法检查（E错），在盐酸溶液中（9→1000）检查2小时，不得有裂缝、崩解或软化现象，再在磷酸盐缓冲液（pH6.8）中检查，1小时内应全部崩解。除另有规定外，大蜜丸及研碎、嚼碎后或用开水、黄酒等分散后服用的丸剂不检查溶散时限。